儿少卫生学的重点研究对象是
A. 从出生后的婴儿到发育成熟的青年
B. 中小学生群体
C. 大学生群体
D. 0~3岁婴幼儿群体
E. 学龄前儿童

正确答案：B。中小学生群体